选择性、可逆性地抑制儿茶酚-O-甲基转移酶，阻止3-O-甲基多巴形成的抗帕金森病药物是
A. 苯海索
B. 金刚烷胺
C. 卡比多巴
D. 恩他卡朋
E. 司来吉兰

正确答案：D。恩他卡朋

解析：本题考查恩他卡朋。选择性、可逆性地抑制儿茶酚-O-甲基转移酶，阻止3-O-甲基多巴形成的抗帕金森病药物是恩他卡朋（D对）；苯海索（A错）为抗帕金森病药物，可以部分阻滞神经中枢（纹状体）的胆碱受体，抑制乙酰胆碱的兴奋作用；金刚烷胺（B错）能阻断甲型流感病毒脱壳及其核酸释放至呼吸道上皮细胞中，对已经穿入细胞内的病毒亦有影响其初期复制的作用；卡比多巴（C错）为外周脱羧酶抑制剂，不易进入中枢，仅抑制外周左旋多巴转化为多巴胺；司来吉兰（E错）为单胺氧化酶抑制药（MAOI）。